二妙散的功用是
A. 清热利水
B. 清热燥湿
C. 清热养阴
D. 利湿消肿
E. 解毒化湿

正确答案：B。清热燥湿

解析：二妙散方证由湿热下注所致，由黄柏、苍术二药相伍，黄柏长于清下焦湿热，苍术长于健脾燥湿。二药相伍，清热燥湿，标本兼顾（B对）。